宫颈糜烂愈合过程中，腺管的开口被阻塞，分泌物滞留于腺腔内，在宫颈表面形成小囊肿
A. 宫颈糜烂
B. 宫颈息肉
C. 宫颈肥大
D. 宫颈腺体囊肿
E. 慢性宫颈管炎

正确答案：D。宫颈腺体囊肿

解析：宫颈糜烂愈合过程中，腺管的开口被阻塞，分泌物滞留于腺腔内，在宫颈表面形成小囊肿是宫颈腺体囊肿（D对）。宫颈糜烂（A错）为子宫颈柱状上皮异位，可为生理性改变也可为病理性改变（P256）。宫颈息肉（B错）是子宫颈管腺体和间质的局限性增生，并向子宫颈外口突出（P256）。宫颈肥大（C错）是慢性炎症的长期刺激导致腺体及间质增生（P256）。慢性宫颈管炎（慢性子宫颈管黏膜炎）（E错）为子宫颈管粘液及脓性分泌物反复发作（P255-P256）。